在研究近期口服避孕药与心肌梗死关系时，因为怀疑年龄是可能的混杂因素，因此只选择35～45岁的妇女作为研究对象，这种控制混杂偏倚的方法是
A. 限制
B. 匹配
C. 随机化抽样
D. 盲法收集资料

正确答案：A。限制

解析：本题考查控制混杂偏倚的方法。在研究设计阶段可以对研究对象采取限制、配比等方法控制混杂偏倚。在研究近期口服避孕药与心肌梗死关系时，因为怀疑年龄是可能的混杂因素，因此只选择35～45岁的妇女作为研究对象，这种控制混杂偏倚的方法是限制（A对BCD错）。